右上1远中邻面龋坏，切角缺损所制备的窝洞类型是
A. Ⅰ类洞
B. Ⅱ类洞
C. Ⅲ类洞
D. Ⅳ类洞
E. V类洞按G.V.Black分类法

正确答案：D。Ⅳ类洞

解析：本题考查银汞充填窝洞的概念。IV类洞（D对）：为发生于前牙邻面并损伤切角的龋损所制备的窝洞。包括切牙和尖牙的邻唇、邻腭（舌）面洞。目前，Ⅳ类洞含义已延伸，包括因牙外伤引起切角缺损的洞。